垂体神经部
A. 本身没有分泌功能
B. 为激素贮存处
C. 储存抗利尿激素和催产素
D. 由神经纤维和神经胶质细胞构成
E. 以上都正确

正确答案：E。以上都正确

解析：垂体表面包裹结缔组织被膜，分为腺垂体和神经垂体两部分。而垂体神经部由神经纤维和神经胶质细胞构成（D对），本身没有分泌功能（A对），只能贮存，为激素贮存处（B对），储存抗利尿激素和催产素（C对，故E为本题正确答案）。